组氨酸是婴幼儿的一种必需氨基酸，它主要富含于
A. 肉类
B. 奶类
C. 蛋类
D. 鱼类
E. 豆类

正确答案：D。鱼类